属于斯德哥尔摩公约之后2009年增加的被控制或消除的持久性有机污染物是
A. 全氟辛烷磺酸
B. 多氯联苯
C. 六氯代苯
D. DDT
E. 艾氏剂

正确答案：A。全氟辛烷磺酸

解析：本题考查斯德哥尔摩公约的内容。本题选项中的5种有机化合物都是被优先控制和消除的持久性有机污染物，其中除了全氟辛烷磺酸（A对BCDE错）是2009年新增加的外，其它4种是在斯德哥尔摩公约规定的12种之列。